在脑桥内的脑神经核是
A. 三叉神经运动核
B. 疑核
C. 孤束核
D. 红核
E. 滑车神经核

正确答案：A。三叉神经运动核

解析：三叉神经运动核（A对）位于脑桥内。疑核（B错）、孤束核（C错）位于延髓内。滑车神经核（E错）位于中脑内。红核（D错）位于中脑内且红核不是脑神经核。